下列是关于学校生活技能与学校生活技能教育的描述，不正确的是
A. 生活技能并非泛指日常生活能力，而专指人的心理社会能力
B. 生活技能是心理健康的重要标志
C. 生活技能教育是连接健康知识、态度、价值观和行为的桥梁
D. 生活技能教育以提供知识为核心，促进青少年心理健康
E. 生活技能的学习以实践为基础，学生是教育活动的主体

正确答案：D。生活技能教育以提供知识为核心，促进青少年心理健康